在底物足量时，生理条件下决定酶促反应速度的是
A. 酶含量
B. 钠离子浓度
C. 温度
D. 酸碱度
E. 辅酶含量

正确答案：A。酶含量

解析：在底物足量时，随着酶浓度的增加，酶促反应速率增大，两者呈现正比关系，即在底物足量时，生理条件下决定酶促反应速度的是酶含量（A对）。辅酶含量（E错）和辅基（如钠离子浓度）（B错）决定酶促反应的性质和类型并不决定酶促反应速度（P56）。温度（C错）和酸碱度（D错）对酶促反应速率的影响具有双重性，因此底物足量时，生理条件下不能决定酶促反应速度。